患者女性，29岁，结婚两年未育，现停经8周感下腹隐痛伴阴道少许流血3天。妇科检查阴道少许血液，宫颈口未扩张，子宫约50天孕大，软，双附件正常最可能的诊断是
A. 慢性盆腔炎
B. 先兆流产
C. 异位妊娠
D. 子宫肌瘤
E. 功能失调性月经紊乱

正确答案：B。先兆流产

解析：掌握“自然流产”知识点。